子宫峡的描述，错误的
A. 是颈、体移行处稍狭窄部位
B. 即子宫阴道上段
C. 非妊娠期此部不明显，长约1cm
D. 妊娠期可延长至7~11cm
E. 妊娠末期，临床称子宫下段

正确答案：B。即子宫阴道上段

解析：子宫颈分为突入阴道的子宫颈阴道部和阴道以上的子宫颈阴道上部两部分。子宫峡是颈、体移行处稍狭窄部位（A对），阴道以上的子宫颈即子宫阴道上段（B错为本题正确答案），非妊娠期此部不明显长约1cm（C对），妊娠期可延长至7~11cm（D对），妊娠末期，临床称子宫下段（E对）。